谷类食品中含量最多的矿物质是
A. 磷
B. 钙
C. 铁
D. 锌
E. 硒

正确答案：A。磷